调整胰岛素剂量最简便的检查是
A. 空腹静脉血糖
B. 空腹指尖血糖
C. 糖化血红蛋白
D. 葡萄糖耐量试验
E. 胰岛素释放试验

正确答案：B。空腹指尖血糖